马钱子内服的用法用量
A. 1～2g，入丸散
B. 0.3～0.6g，入丸散
C. 2～5g，入煎剂
D. 3～9g，入煎剂
E. 0.1～0.3g，入丸散

正确答案：B。0.3～0.6g，入丸散

解析：马钱子的用法用量是0.3-0.6g炮制后入丸散用，外用适量，研末调涂。内服不宜生用及多服久服（B对）。具有散结消肿，通络止痛的功效。